某女，25岁。小便频数短涩，灼热刺痛，尿色黄赤，少腹拘急胀痛，时作寒热，口苦，呕恶，腰痛拒按，大便秘结；舌质红，苔黄腻，脉滑数。辨析其证候是
A. 热淋
B. 血淋
C. 气淋
D. 膏淋
E. 劳淋

正确答案：A。热淋

解析：本题考查淋证之热淋的症状。辨析其证候是淋证之热淋（A对）。淋证之热淋【症状】小便频数短涩，灼热刺痛，尿色黄赤，少腹拘急胀痛，或有寒热，口苦，呕恶，或腰痛拒按，或大便秘结。舌质红，苔黄腻，脉滑数。淋证之血淋（B错）【症状】小便热涩刺痛，尿色深红，或夹有血块，疼痛满急加剧，或见心烦。舌尖红，舌苔黄，脉滑数。淋证之气淋（C错）【症状】郁怒之后，小便涩滞，淋沥不宣，少腹胀满疼痛。舌苔薄白，脉弦。淋证之膏淋（D错）【症状】小便浑浊，乳白或如米泔水，上有浮油，置之沉淀，或伴有絮状凝块物，或混有血液、血块，尿时热涩疼痛，口干。舌质红，苔黄腻，脉濡数。淋证之劳淋（E错）【症状】小便不甚赤涩，溺痛不甚，但淋沥不已，时作时止，遇劳即发，腰膝酸软，神疲乏力，病程缠绵。舌质淡，脉细弱。